早产儿指甲外观特点是
A. 指甲硬
B. 反甲
C. 甲面多白纹
D. 指甲未达指尖
E. 指甲超过指尖

正确答案：D。指甲未达指尖

解析：早产儿又称未成熟儿，指（趾）甲未达到指、趾端（D对）。足月儿指（趾）甲达到或超过指、趾端（E错）。